急性腹泻一般是指起病急，病程在
A. 3天以内
B. 5天以内
C. 1周以内
D. 2周以内
E. 1个月以内

正确答案：D。2周以内

解析：本题考查急性腹泻。急性腹泻一般是指起病急，病程在2周以内（D对ABCE错）。